哪项不是牙源性角化囊性瘤X线的特点
A. 有单囊和多囊之分，单囊多见
B. 沿颌骨长轴发展
C. 下颌多见
D. 牙根吸收多呈截断状
E. 囊肿可向舌侧膨隆

正确答案：D。牙根吸收多呈截断状

解析：牙源性角化囊肿的X线表现为：①有单囊和多囊之分，单囊多见，也可为多房；多房者分房大小相近。②常沿颌骨长轴生长，膨胀不明显；如有膨胀，可向舌侧。③牙根吸收少见，多呈斜面状。④病变内可含牙或不含牙。掌握“牙源性颌骨囊肿”知识点。